治疗风寒感冒选穴、方义错误的是
A. 风池疏风散邪
B. 合谷解表散寒
C. 尺泽调理益气
D. 列缺宣肺解表
E. 外关疏风解表

正确答案：C。尺泽调理益气

解析：尺泽（C错，为本题正确答案）主治咳嗽、气喘、咯血、咽喉肿痛等肺系实热病证，点刺出血治风热感冒，尺泽不适于治疗风寒感冒。风池（A对）为足少阳胆经之穴，主治中风、癫痫、头痛、眩晕、耳鸣、耳聋等内风所致病证和感冒、鼻塞、目赤肿痛、口眼歪斜、口眼歪斜等外风所致的病证。合谷（B对）为大肠经之原穴，治疗发热恶寒等外感病证，热病无汗或多汗。列缺（D对）主治手腕痛、肺系疾病及头面部疾病，对于风寒感冒可起宣肺解表之功。外关（E对）为三焦经络穴，有解表作用。